有五个不同职业人群的冠心病患病率资料，若比较职业不同患病率是否相同。图示对比不同职业人群的冠心病患病率的高低，应绘制
A. 普通线图
B. 直条图
C. 直方图
D. 圆图
E. 散点图

正确答案：B。直条图

解析：题中通过五个不同职业人群的冠心病患病率资料，比较职业不同患病率之间的关系，属于相互独立的统计指标之间数值大小和对比关系的比较，应绘制直条图（B对）。线图（A错）是用线段的升降来表示指标（变量）的连续变化情况，适用于描述一个变量随另一个变量变化趋势。直方图（C错）用直条矩形面积代表各组频数，各矩形面积总和代表频数的总和，它主要用于表示连续变量频数分布情况。圆图（D错）中把圆的总面积作为100%，表示事物的全部，而圆内各扇形面积用来表示全体中各部分所占的比例。散点图（E错）用点的密度和变化趋势表示两指标之间的直线和曲线关系。